可以防止食物嵌塞的固位体
A. 基托
B. 卡环臂
C. 单个支托
D. 卡环体
E. （牙合）支托

正确答案：E。（牙合）支托

解析：（牙合）支托：是卡环伸向基牙（牙合）面而产生支持作用的部分，防止义齿龈向移位，可保持卡环在基牙上的位置。如果余留牙间有间隙，（牙合）支托安放其间可以防止食物嵌塞。如果基牙倾斜移位，与对颌牙接触不良或无（牙合）接触，还可加大（牙合）支托以恢复咬合关系。掌握“局部义齿人工牙及基托”知识点。